引起流行性出血热的病原体是
A. 汉坦病毒
B. 登革病毒
C. 黄热病毒
D. lassa病毒
E. 新疆出血热病毒

正确答案：A。汉坦病毒

解析：引起流行性出血热的病原体是汉坦病毒（A对），汉坦病毒在临床上主要引起两种急性传染病，一种是肾综合征出血热，另一种是汉坦病毒肺综合征。